幽门梗阻的呕吐物特点是
A. 含有隔餐或隔日食物
B. 有粪臭味
C. 混有蛔虫
D. 少量黏液
E. 带有大量鲜血

正确答案：A。含有隔餐或隔日食物

解析：呕吐隔餐或隔日食物，并含腐酵气味，见于幽门梗阻（A对）。呕吐物有粪臭者提示低位肠梗阻（B错）。呕吐物中有蛔虫者见于胆道蛔虫（C错）。呕吐物有大量酸性液体者多有胃泌素瘤或十二指肠溃疡，无酸味者可能为责门狭窄或贲门失弛缓症（D错）。呕吐物性质呕吐物呈咖啡色，见于上消化道出血（E错）。